下列有关慢性阻塞性腮腺炎说法错误的
A. 多为单侧受累
B. 多发生于儿童
C. 男性发病略多于女性
D. 晨起感觉腮腺区发胀
E. 有“咸味”液体自导管口流出

正确答案：B。多发生于儿童

解析：男性发病略多于女性，大多发生于中年。多为单侧受累，也可为双侧。患者常不明确起病时间，多因腮腺反复肿胀而就诊。约占半数患者肿胀与进食有关；发作次数变异较大，多者每次进食都肿胀，少者1年内很少发作，大多平均每月发作一次以上。发作时伴有轻微疼痛，这是因为进食时唾液分泌增加并黏稠，排出受阻所致。有的患者腮腺肿胀与进食无明确关系，晨起感觉腮腺区发胀，自己稍加按摩后即有“咸味”液体自导管口流出，随之局部感到松快。掌握“慢性阻塞性腮腺炎”知识点。